能够使片剂在胃肠液中迅速破裂成细小颗粒的制剂辅料是
A. 表面活性剂
B. 络合剂
C. 崩解剂
D. 稀释剂
E. 黏合剂

正确答案：C。崩解剂

解析：本题考查片剂的常用辅料。崩解剂（C对）系指促使片剂在胃肠液中迅速破裂成细小颗粒的辅料。表面活性剂（A错）是指具有很强的表面活性，能使液体的表面张力显著下降的物质。络合剂（B错）也称螯合剂，是指能与金属离子形成络合离子的化合物。稀释剂（D错）的主要作用是用来增加片剂的重量或体积，亦称为填充剂。黏合剂（E错）系指依靠本身所具有的黏性赋予无黏性或黏性不足的物料以适宜黏性的辅料。